痢疾杆菌属
A. 志贺菌属
B. 奈瑟菌属
C. 链球菌属
D. 埃希菌属
E. 沙门菌属

正确答案：A。志贺菌属

解析：细菌性痢疾简称菌痢，是由志贺菌也称痢疾杆菌引起的肠道传染病。以腹痛、腹泻、排黏液脓血便、里急后重等为主要表现，严重者可出现感染性休克和（或）中毒性脑病。少数患者可演变为慢性。志贺菌属于肠杆菌科志贺菌属，革兰阴性杆菌，无芽胞，无荚膜，无鞭毛，多数有菌毛，为兼性厌氧菌（A对）。